属于光化学反应产物的是
A. SO₂
B. CO
C. H₂S
D. PAH
E. PAN

正确答案：E。PAN

解析：本题考查光化学反应产物。光化学反应是指物质由于光的作用而引起的化学反应，其产物主要有臭氧、醛类以及各种过氧酰基硝酸酯（PAN）（E对ABCD错）。